根据收集资料时具体方法的不同，可分为问卷访谈法和自填问卷法。在自填法中，最常用的是
A. 面谈法
B. 信函调查法
C. 电话调查法
D. 集中调查法

正确答案：B。信函调查法

解析：本题考查最常用的自填法。信函调查法是由调查者将问卷邮寄给调查对象，调查对象按照要求填写问卷，再寄回给调查者的一种收集资料的方法。在自填法中，信函调查法（B对ACD错）是最常用的一种方法，它不需要直接接触调查对象，不涉及交通，不需要现场组织工作，不需要培训调查员，比较节省时间和费用。调查对象可以根据自己在时间和地点上的方便来回答问题，可以避免现场自填时间紧张、时间冲突和周围环境的影响。